女，46岁。今晨起咯血约100ml，无发热。幼年起反复咳嗽、咳痰。查体：体温36.8℃，血压120/70mmHg，左肺可闻及湿啰音。该患者最可能的诊断是
A. 肺结核
B. 支气管扩张
C. 支气管肺癌
D. 慢性支气管炎
E. 肺炎链球菌肺炎

正确答案：B。支气管扩张

解析：掌握“支气管扩张”知识点。